控释制剂的作用原理是影响药物的
A. 扩散
B. 溶解
C. 渗透压
D. 解离
E. 排泄

正确答案：A、C。扩散；渗透压

解析：本题考查缓（控）释制剂。控释制剂的作用原理包括扩散（A对）原理、溶蚀与扩散、溶出结合原理、渗透压（C对）原理。由于药物的释放受溶出速度的限制，溶出速度慢的药物显示出缓释的性质，而非控释（B错）。离子交换系统是由水不溶性交联聚合物组成的树脂，其聚合物链的重复单元上含有成盐基团，药物可结合于树脂上，当带有适当电荷的离子与离子交换基团接触时，通过交换将药物游离释放出来（D错）。排泄是药物及其代谢产物排出体外的过程（E错）。